影响龋病流行的人群分布因素中不包括
A. 年龄
B. 饮食
C. 性别
D. 城乡
E. 民族

正确答案：B。饮食

解析：本题考查影响龋病流行的人群分布因素。影响龋病流行的人群分布因素中不包括饮食（B错，为本题的正确答案）。饮食习惯是影响龋病流行的因素之一，不属于人群分布因素，流行病学研究表明，糖的摄入量、摄入频率及糖加工的形式与龋病有密切关系。影响龋病流行的人群分布因素有：1.年龄（A对）：龋病患病随年龄而变化，在人的一生之中，乳牙、年轻恒牙和老年人牙龈退缩后的恒牙易感龋病。2.性别（C对）：乳牙患龋率男性略高于女性，而恒牙患龋率女性略高于男性。3.城乡（D对）：在发展中国家，一般城市居民的患龋率高于农村，但是在社会经济状况较好的城市，预防保健措施的实施使得这些地区的龋病状况得到了明显控制，因而出现了农村居民龋病患病率高于城市居民的现象。4.民族（E对）：在一个国家内，不同民族之间患龋情况也不同，这是由于饮食习惯、人文、地理环境等不同所致。